一侧胸锁乳突肌收缩
A. 使头向同侧屈，脸转向同侧
B. 使头向对侧屈，脸转向同侧
C. 使头向同侧屈，脸转向对侧
D. 使头向对侧屈，脸转向对侧
E. 使头前屈

正确答案：C。使头向同侧屈，脸转向对侧

解析：一侧胸锁乳突肌收缩使头向同侧屈，脸转向对侧（C对）。两侧胸锁乳突肌同时收缩可使头后仰。